围绝经期保健的主要要点是
A. 合理营养
B. 保持外阴清洁
C. 防治绝经前期月经失调
D. 自然生理过程不需治疗
E. 预防生殖道萎缩及子宫脱垂的发生

正确答案：C。防治绝经前期月经失调

解析：本题考查围绝经期保健的主要要点。到了更年期，无排卵月经增多，月经会发生变化，按时作好记录，防治绝经前期月经失调（C对ABDE错），是围绝经期保健的主要要点。